患者，女，65岁，间断腹胀、纳差6年，因病情加重伴精神恍惚3天为主诉入院，实验室检查：ALT200U/L，AST320U/L，诊断为肝硬化失代偿期、肝性脑病。患者乙肝病史20年，间断服用中药（具体不详）治疗。糖尿病史10年，便秘多年，3～4天排便一次。为治疗该患者的便秘并改善肝性脑病症状，应首选的药物是
A. 比沙可啶
B. 乳果糖
C. 硫酸镁
D. 开塞露
E. 聚乙二醇

正确答案：B。乳果糖

解析：本题考查乳果糖。为治疗该患者的便秘并改善肝性脑病症状，应首选的药物是乳果糖（B对）。便秘合并肝性脑病首选乳果糖，乳果糖用于肝昏迷或昏迷前期的治疗剂量较高，糖尿病患者应慎用。该患者肝性脑病比较严重，首先应该改善肝昏迷症状，故选用乳果糖。比沙可啶（A错）、硫酸镁（C错）、开塞露（D错）、聚乙二醇（E错）均可治疗便秘，但不能改善肝性脑病症状。